治泻九法是哪一部书提出的
A. 《医贯》
B. 《伤寒论》
C. 《医宗必读》
D. 《医学心悟》
E. 《医学三字经

正确答案：C。《医宗必读》

解析：李中梓在《医宗必读•泄泻》中提出治泻九法，即淡渗、升提、清凉、疏利、甘缓、酸收、燥脾、温肾、固涩…（C对）。